男，35岁。既往视神经炎，现在感染肺结核，准备抗结核治疗，不适合使用的药物为
A. 异烟肼
B. 利福平
C. 乙胺丁醇
D. 链霉素
E. 吡嗪酰胺

正确答案：C。乙胺丁醇

解析：乙胺丁醇不良反应是视神经炎，故既往有视神经元的结核患者不适合使用（C对）。异烟肼的主要不良反应是周围神经炎（A错）。利福平的主要不良反应是肝功能损害（B错）。链霉素的主要不良反应是听力和肾损害（D错）。吡嗪酰胺的主要不良反应是肠胃不适（E错）。